《中国药典》规定，以总黄酮为含量测定指标成分的中药是
A. 三七
B. 槐花
C. 五味子
D. 细辛
E. 天仙子

正确答案：B。槐花

解析：本题考查的是槐花含量测定的指标成分。《中国药典》规定，以总黄酮为含量测定指标成分的中药是槐花（B对）。槐米含有芦丁，槲皮素，皂苷，白桦脂醇，槐二醇以及槐米甲、乙、丙素和黏液质等。其中，芦丁是有效成分，可用于治疗毛细血管脆性引起的出血症，并用做高血压的辅助治疗剂。据近代研究表明槐米中芦丁的含量高达23.5%，槐花开放后降至13.0%。《中国药典》以总黄酮和芦丁为指标成分对槐米或槐花进行含量测定。要求槐花总黄酮（以芦丁计）不少于8.0%，槐米总黄酮不少于20.0%，对照品采用芦丁；要求芦丁含量，槐花不得少于6.0%，槐米不得少于15.0%。三七（A错）中主要化学成分是三萜皂苷类，含量高达12%。《中国药典》以人参皂苷Rg₁、人参皂苷Rb₁及三七皂苷R₁为指标成分进行含量测定，要求三者总含量不得少于5.0%。五味子（C错）中含木脂素较多，约为5%。《中国药典》采用高效液相色谱法测定药材中五味子醇甲的含量，要求不得少于0.40%。辽细辛（D错）的主要化学成分为挥发油、木脂素类和黄酮类等。挥发油约占其含量的3%。《中国药典》以细辛脂素为指标成分进行含量测定，含量不得少于0.050%。同时规定挥发油不得少于2.0%（ml/g）。天仙子（E错）主要的生物碱有莨菪碱和东莨菪碱等。《中国药典》以东莨菪碱和莨菪碱为指标成分进行含量测定，要求两者总量不得少于0.080%。